对于服从双变量正态分布的资料，如果直线相关分析得出的r值越大，则经回归分析得到相应的b值
A. 越大
B. 越小
C. 比r小
D. 比r大
E. 可能较大也可能较小

正确答案：E。可能较大也可能较小